某病在某地区显著超过该病历年散发发病率水平时，称
A. 散发
B. 暴发
C. 流行
D. 大流行

正确答案：C。流行

解析：本题考查流行的概念。流行（C对ABD错）是指在某地区某病的发病率显著超过该病历年发病率水平，相对于散发，流行出现时各病例之间呈现明显的时间和空间联系。